环磷酰胺的主要不良反应是
A. 心脏毒性
B. 肾脏毒性
C. 肺脏毒性
D. 骨髓毒性
E. 皮肤毒性

正确答案：D。骨髓毒性

解析：环磷酰胺的主要不良反应是骨髓抑制即骨髓毒性（D对），白细胞往往在给药后10～14天最低，多在第21天恢复正常；常见的副反应还有恶心、呕吐。心脏毒性（A错）主要为阿霉素的不良反应。肾脏毒性（B错）主要为环孢素的不良反应。肺脏毒性（C错）、皮肤毒性（E错）较少药物导致肺脏毒性和皮肤毒性。